女性，51岁，间断上腹疼痛2年，疼痛发作与情绪、饮食有关。查：上腹部轻压痛。胃镜：胃窦皱襞平坦，粘膜粗糙无光泽，粘膜下血管透见。此病例考虑诊断为
A. 消化性溃疡
B. 急性胃炎
C. 慢性浅表性胃炎
D. 胃癌
E. 慢性萎缩性胃炎

正确答案：E。慢性萎缩性胃炎

解析：中老年女性患者，有间断上腹痛两年病史，胃镜表现为胃窦皱壁平坦，黏膜粗糙无光泽，黏膜下血管透见（慢性萎缩性胃炎的典型表现），此病例考虑诊断为慢性萎缩性胃炎（E对）。消化性溃疡（P359）（A错）患者表现为周期性上腹痛，胃镜表现为边缘光滑，底部由肉芽组织构成，覆以灰黄色渗出物，周围黏膜常有炎症水肿。急性胃炎（B错）通常发病较为紧急，胃镜表现为胃黏膜糜烂和出血。慢性浅表性胃炎（P354）（C错）（慢性非萎缩性胃炎）患者胃镜表现为红黄相间，黏膜皱襞增粗。胃癌（P365）（D错）患者胃镜表现为肿瘤表面凹凸不平，糜烂，有污秽苔，也可呈深大溃疡。